评价拟建工程项目的环境影响称为
A. 环境质量评价
B. 环境污染影响评价
C. 环境影响评价
D. 环境工程影响评价
E. 污染源环境影响评价

正确答案：C。环境影响评价

解析：本题考查环境影响评价。评价拟建工程项目的环境影响称为环境影响评价（C对ABDE错）。环境影响评价是指对规划和建设项目实施后可能造成的环境影响进行分析、预测和评估，提出预防或者减轻不良环境影响的对策和措施，并进行跟踪监测的方法与制度。